胸痹的主要病机为
A. 气滞血瘀
B. 寒凝气滞
C. 痰瘀交阻
D. 阳气虚衰
E. 心脉痹阻

正确答案：E。心脉痹阻

解析：题中选项均可导致胸痹，肝失疏泄，气机郁滞，致心脉不和可发为胸痹。血行瘀滞，胸阳痹阻，致心脉不和发为胸痹。阴寒凝滞，气血痹阻，致心阳不振，心脉运行不畅，发为胸痹痰浊、瘀血结于胸中，阻滞心脉，胸阳不展，气机不畅，发为胸痹。阳气虚衰，胸阳不振，气机痹阻，血行瘀滞，致心脉痹阻，发为胸痹。可见无论是寒凝、气滞、痰浊、血瘀、阳虚等均导致心脉痹阻而发为胸痹（E对)（ABCD错）。